严重心力衰竭时，治疗频发室性期前收缩首选的药物是
A. 胺碘酮
B. 索他洛尔
C. 多巴酚丁胺
D. 氟卡胺
E. 普罗帕酮

正确答案：A。胺碘酮

解析：胺碘酮是多通道阻滞剂，可表现出I～IV类所有抗心律失常药物的药理作用。包括：⑴轻度阻滞钠通道，作用于通道失活态，特点是心率快时阻滞作用强，但没有I类抗心律失常药物所特有的促心律失常作用。⑵阻滞钾通道，胺碘酮可同时抑制慢、快成分的延迟整流钾电流（Iks、Ikr），特别是开放状态的Iks。一般的钾通道阻滞剂多作用于Ikr，Ikr是心动过缓时的主要复极电流，因此该通道阻滞剂表现出逆使用依赖特性，即在心率减慢时作用加强，易诱发尖端扭转型室速（Tdp）。但在心动过速时，Iks复极电流加大，此时胺碘酮作用较强，表现为使用依赖性，即在快速心率时胺碘酮仍有抗心律失常作用。胺碘酮延长动作电位时程，但基本不诱发Tdp ，这是因为胺碘酮虽可延长心房和心室的动作电位时程，但不诱发后除极电位。⑶阻滞L型钙通道，抑制早期后除极（EAD）和延迟后除极（DAD）。